三臂卡环包绕基牙的轴面角
A. 1个
B. 2个
C. 4个
D. 5个
E. 7个

正确答案：C。4个

解析：三臂卡环：多用于牙冠外形好，无明显倾斜的基牙。卡环由颊、舌两个卡环臂和（牙合）支托组成。包绕基牙的3个或4个轴面角，小连接体和（牙合）支托连接，属于标准的圆环卡环，应用最为广泛，卡环的固位、支持和稳定作用均好。掌握“局部义齿固位体”知识点。